基础培养基的消毒灭菌常用的方法是
A. 高压蒸汽灭菌法
B. 紫外线消毒法
C. 巴氏消毒法
D. 滤过除菌法
E. 干烤法

正确答案：A。高压蒸汽灭菌法

解析：高压蒸汽灭菌法：常用于培养基、葡萄糖盐水输液、敷料及各种耐高温耐湿物品的灭菌。掌握“消毒与灭菌”知识点。